脂肪酸β-氧化和酮体生成共同中间产物是
A. 乙酰乙酰辅酶A
B. 甲基二羟戊酸
C. 草酰乙酸
D. 乙酰乙酸
E. β-羟丁酸

正确答案：A。乙酰乙酰辅酶A